血白细胞总数增多，可见于
A. 伤寒杆菌感染
B. 再生障碍性贫血
C. 急性失血
D. 脾功能亢进
E. 以上均非

正确答案：C。急性失血

解析：白细胞总数的增减主要受中性粒细胞的影响，反应性中性粒细胞增多可见于急性大出血、溶血；如脾破裂或宫外孕破裂后，白细胞迅速增高（C对E错）。伤寒杆菌感染多见嗜酸粒细胞减少（A错）。脾亢时血细胞减少，但细胞形态正常。早期以白细胞及血小板减少为主，重度脾亢时可出现三系明显减少（D错）。